沙眼主要应用滴眼剂治疗，《国家非处方药目录》收载的治疗沙眼的制剂有
A. 10%磺胺醋酰钠滴眼剂
B. 0.25%硫酸锌滴眼剂
C. 0.1%酞丁安滴眼剂
D. 0.1%利福平滴眼剂
E. 2.5%林可霉素滴眼剂

正确答案：A、B、C。10%磺胺醋酰钠滴眼剂；0.25%硫酸锌滴眼剂；0.1%酞丁安滴眼剂

解析：本题考查沙眼治疗药。沙眼主要应用滴眼剂治疗，《国家非处方药目录》收录的治疗沙眼的制剂有10%磺胺醋酰钠（A对）、0.25%硫酸锌（B对）、0.1%酞丁安滴眼剂（C对）和0.5%红霉素眼膏。0.1%利福平滴眼剂（D错）用于由细菌感染引起的急性卡他性结膜炎，属于非处方药；林可霉素滴眼剂（E错）用于敏感菌感染所致结膜炎，角膜炎等，属于处方药。